氯己定抗菌斑主要作用细菌的
A. 细胞核
B. 细胞浆
C. 细胞膜
D. 细胞质
E. 细胞壁

正确答案：E。细胞壁

解析：本题考查化学药物控制菌斑-氯己定。氯己定抗菌斑主要作用细菌的细胞壁（E对）。氯己定通过吸附到细菌表面作用于细菌的细胞壁。